使软腭上提，咽侧壁向内侧运动的是
A. 舌腭肌
B. 咽腭肌
C. 悬雍垂肌
D. 腭帆张肌
E. 腭帆提肌

正确答案：E。腭帆提肌

解析：腭帆提肌：使软腭上提，咽侧壁向内侧运动。掌握“腭、舌、舌下区的局部解剖”知识点。